下列关于总体和样本说法正确的是
A. 总体的指标称为参数，用拉丁字母表示
B. 样本的指标称为统计量，用希腊字母表示
C. 总体中随机抽取的部分观察单位组成了样本
D. 总体中随机抽取的部分观察单位的变量值组成了样本
E. 总体中随意抽取的部分观察单位的变量值组成了样本

正确答案：D。总体中随机抽取的部分观察单位的变量值组成了样本

解析：本题考查总体和样本的相关内容。参数用于刻画总体的数值特征，如总体均数等，参数被看成总体某种特征的固定数值，通常参数的确切值未知，总体参数通常用希腊字母表示。统计量用于描述样本的数值特征，如样本均数等，当获得一个样本后就可以得到统计量的值，可用于估计未知参数的值，统计量的值随样本改变而改变，样本统计量通常用小写英文字母表示。样本是为了解总体而观测的总体的一部分，我们常常从一个总体中随机抽取具有代表性的样本进行调查（D对ABCE错）。